以下哪项特点为局部上皮呈外生性和息肉样增生形成的疣状外观的肿物，但无纤维上皮增生
A. 血管性龈瘤
B. 乳头状瘤
C. 成釉细胞癌
D. 分叶状毛细胞血管瘤
E. 纤维性龈瘤

正确答案：B。乳头状瘤

解析：乳头状瘤是一组局部上皮呈外生性和息肉样增生形成的疣状或菜花状外观的肿物，但不包括纤维上皮增生。掌握“乳头状瘤及牙龈瘤”知识点。